在胆囊造影时，为检查胆囊的收缩功能，让受检查者进食油煎荷包蛋是为了促进
A. 胆盐合成
B. 胆固醇合成
C. 促胃液素分泌
D. 缩胆囊素分泌
E. 迷走神经兴奋

正确答案：D。缩胆囊素分泌